在醋酸可的松注射液中作为抑菌剂的是
A. 硫柳汞
B. 氯化钠
C. 羟甲基纤维素钠
D. 聚山梨酯80
E. 注射用水

正确答案：A。硫柳汞

解析：本题考查液体制剂常用的附加剂。硫柳汞（A对）可作药物制剂的抑菌剂；氯化钠（B错）一般为渗透压调节剂；羟甲基纤维素钠（C错）常作为助悬剂；聚山梨酯80（D错）可作乳化剂、增溶剂；注射用水（E错）作为溶剂。